在毒性较大的微囊藻毒素中，毒性最强的是
A. MC-RR
B. MC-YR
C. MC-LR
D. MC-ER
E. MC-ZR

正确答案：C。MC-LR

解析：本题考查毒性最强的微囊藻毒素。微囊藻毒素有70多种异构体，毒性较大的是MC-LR、MC-RR和MC-YR。其中毒性最强的是MC-LR型（C对ABDE错），它主要累及肝脏，引起肝脏大面积肿胀、出血、坏死、肝细胞结构和功能破坏，严重者可因肝功能衰竭而死亡。